婴儿性比例稳定是指出生时性比例比值为
A. 100～102
B. 105～106
C. 98～100
D. 102～104
E. 106～108

正确答案：B。105～106

解析：本题考查婴儿性比例稳定值。婴儿性比例稳定是指出生时性比例比值为105～106（B对ACDE错）。